有眩晕、眼震、构音障碍、交叉性瘫痪，见于
A. 椎-基底动脉血栓形成
B. 大脑前动脉血栓形成
C. 大脑中动脉血栓形成
D. 蛛网膜下腔出血
E. 小脑出血

正确答案：A。椎-基底动脉血栓形成

解析：眩晕与眼震可见于前庭神经系统病变；构音障碍见于与发音相关的中枢神经、周围神经或肌肉病变；交叉性瘫痪见于一侧脑干受损，由于损害已交叉的皮质脑干束纤维或颅神经与核、以及未交叉的皮质脊髓束而导致的病灶侧的周围型脑神经麻痹和对侧肢体的中枢性偏瘫。故而有眩晕眼震构音障碍交叉性瘫痪，见于脑干病变导致的皮质脊髓束以及脑神经核受损。脑干是由椎-基底动脉供血（椎-基底动脉供应大脑半球后1/3及部分间脑、脑干和小脑），椎-基底动脉血栓形成（A对）时可出现阵发性眩晕、眼震以及构音障碍、交叉性瘫痪等脑干缺血综合征。大脑前动脉和大脑中动脉均属于颈内动脉系统，供应大脑半球前2/3和部分间脑，大脑前动脉血栓形成（B错）和大脑中动脉血栓形成（C错）不会导致脑干功能受损，而出现眩晕眼震构音障碍交叉性瘫痪。蛛网膜下腔出血（D错）表现为头痛、脑膜刺激征、眼部症状、谵妄和幻觉等。小脑出血（E错）表现为频繁呕吐、枕部剧烈疼痛、行动不稳、共济失调和眼球震颤，但不会有构音障碍和交叉性瘫痪。